属于固体剂型的有
A. 散剂
B. 膜剂
C. 合剂
D. 栓剂
E. 酊剂

正确答案：A、B、D。散剂；膜剂；栓剂

解析：本题考查固体制剂的分类。属于固体剂型的有散剂（A对）、膜剂（B对）、栓剂（D对）。固体制剂系指散剂、颗粒剂、胶囊剂、片剂等以固体形式给药的药物制剂，可供口服或外用。按不同的剂型分类，固体制剂分为散剂、颗粒剂、胶囊剂、片剂等。膜剂系指药物溶解或分散于成膜材料中或包裹于成膜材料中加工成的薄膜制剂，是固体制剂。栓剂指药物与适宜基质制成的具有一定形状的供人体腔道内给药的固体外用制剂。合剂（C错）指由两种或两种以上可溶性或不溶性药物制成的液体制剂。酊剂（E错）系指药物用规定浓度的乙醇浸出或溶解而制成的液体制剂，也可用流浸膏稀释制得。